在治疗量时，主要兴奋大脑皮层的药物是
A. 尼克刹米
B. 洛贝林
C. 贝美洛
D. 咖啡因
E. 二甲弗林

正确答案：D。咖啡因